急性肾盂肾炎尿中最常见的管型为
A. 白细胞管型
B. 红细胞管型
C. 透明管型
D. 颗粒管型
E. 蜡样管型

正确答案：A。白细胞管型

解析：白细胞管型表示肾小管内有炎症变化，见于急慢性肾盂肾炎（A对），间质性肾炎等。红细胞管型（B错）是指管型中红细胞含量超过体积的1/3，是由于肾小球或肾小管出血所致，常见于急性肾小球肾炎、急进性肾炎、慢性肾炎、紫癜性肾炎、狼疮性肾炎等。透明管型（C错）偶可出现在正常人中，在肾病综合症、慢性肾炎、恶性高血压和心力衰竭时可见增多。颗粒管型（D错）多见于慢性肾炎、肾盂肾炎或某些原因引起的肾小管损伤。蜡样管型（E错）提示有严重的肾小管变性坏死，预后不良。